肝性脑病可见到的症状是
A. 静止性震颤
B. 动作性震颤
C. 老年性震颤
D. 扑翼样震颤
E. 手足搐搦

正确答案：D。扑翼样震颤

解析：肝性脑病见到的症状是扑翼样震颤（D对）。静止性震颤见于帕金森病（A错）。动作性震颤见于小脑病变（B错）。老年性震颤多属于运动障碍疾病，病因未明（C错）。手足搐搦见于血钙过低、血镁过低或血钠过高（E错）。